根据《传染病防治法》要求，能增加或减少乙类传染病的机构是
A. 当地政府部门
B. 全国人大常委会
C. 县级卫生部门
D. 国务院卫生行政部门
E. 疾病控制预防中心

正确答案：D。国务院卫生行政部门

解析：根据传染病病种的传播方式、传播速度、流行强度以及对人体健康、对社会危害程度的不同，参照国际统一分类标准，《传染病防治法》将列为法定管理的传染病分为甲类、乙类和丙类三类。国务院卫生行政部门可根据其暴发、流行情况和危害程度决定并予以公布其他需要列入乙类、丙类传染的传染病（D对ABCE错）。